患儿，1岁。发热3天，流涕咳嗽，咽部及眼结膜充血，在下眼睑边缘见Stimson线，口腔黏膜充血，既往未接种麻疹疫苗。该患者诊断麻疹，属于麻疹病程哪一期
A. 潜伏期
B. 前驱期
C. 卡他期
D. 出疹期
E. 恢复期

正确答案：B。前驱期

解析：麻疹前驱期（B对）一般为3～4天。这一期的主要表现类似上呼吸道感染症状：①发热；②咳嗽、流涕、流泪、咽部充血等上呼吸道感染卡他期（C错）症状，以眼症状突出，结膜发炎、眼睑水肿、眼泪增多、畏光、下眼睑边缘有一条明显充血横线即Stimson线。③Koplik斑，在发疹前24～48小时出现，为直径约1.0mm灰白色小点，外有红色晕圈，始发于对着下臼齿的颊黏膜上，可累及整个颊黏膜并蔓延至唇部黏膜，皮疹出现后即逐渐消失。潜伏期（A错）平均持续约10天左右，无明显症状。出疹期（D错）多在发热后3～4天。体温可突然升高至40℃～40.5℃，皮疹为稀疏不规则的红色斑丘疹，疹间皮肤正常，出疹顺序也有特点：始见于耳后、颈部、沿着发际边缘，24小时内向下发展，遍及面部、躯干及上肢，第3天皮疹累及下肢及足部。病情严重者皮疹常融合，皮肤水肿，面部水肿变形。大部分皮疹压之褪色，但亦有出现淤点者。全身有淋巴结肿大和脾肿大，并持续几周，肠系膜淋巴结肿大可引起腹痛、腹泻和呕吐。恢复期（E错）出疹3～4天后皮疹开始消退，消退顺序与出疹时相同；在无合并症发生的情况下，食欲、精神等其他症状也随之好转，体温减退。